荆芥除祛风解表外，又能
A. 行气宽中
B. 温肺化饮
C. 透疹止痒
D. 凉血止血
E. 利水消肿

正确答案：C。透疹止痒

解析：本题考查的是荆芥的功效。荆芥除祛风解表外，又能透疹止痒（C对）。荆芥：【功效】散风解表，透疹止痒，止血。紫苏：【功效】发表散寒，行气宽中（A错），安胎，解鱼蟹毒。细辛：【功效】祛风散寒，通窍，止痛，温肺化饮（B错）。桑叶：【功效】疏散风热，清肺润燥，平肝明目，凉血止血（D错）。麻黄：【功效】发汗解表，宣肺平喘，利水消肿（E错）。